以下符合恶性高血压的是
A. 患者血压明显升高，体检：血压200/130mmHg（266/169kP），眼底出血渗出视乳头水肿，实验室报告：肾功能不全
B. 患者血压明显升高，伴有剧烈头痛呕吐抽搐
C. 患者平日有心悸胸痛劳力时气促起立或运动时眩晕，体检：胸骨左缘第3～4肋间可闻较粗糙的喷射性收缩期杂音，屏气时杂音增强
D. 患者一周前出现发热，全身无力，现自觉心悸胸闷，体检：心率120次/分，偶闻室性早搏，实验室回报CPK、GOT（AST）、LDH增高
E. 患者气急，端坐呼吸，体检：心脏扩大，听诊可闻及第四心音奔马律，双下肢浮肿，超声心动图报告：左心室腔明显扩大

正确答案：A。患者血压明显升高，体检：血压200/130mmHg（266/169kP），眼底出血渗出视乳头水肿，实验室报告：肾功能不全

解析：恶性高血压是指患者病情急骤发展，舒张压持续≥130mmHg，并有头痛，视力模糊，眼底出血、渗出和视盘水肿，肾脏损害突出，持续蛋白尿、血尿与管型尿。患者血压明显升高，体检：血压200/130mmHg（26.6/16.9kPa），眼底出血渗出视乳头水肿，实验室报告：肾功能不全（A对）符合恶性高血压。患者血压明显升高，伴有剧烈头痛呕吐抽搐（B错）符合高血压脑病。患者平日有心悸胸痛劳力时气促起立或运动时眩晕，体检：胸骨左缘第3～4肋间可闻较粗糙的喷射性收缩期杂音，屏气时杂音增强（C错）符合肥厚型心肌病（P266）。患者一周前出现发热，全身无力，现自觉心悸胸闷，体检：心率120次/分，偶闻室性早搏，实验室回报CPK、GOT（AST）、LDH增高（D错）符合心肌炎（P270）。患者气急，端坐呼吸，体检：心脏扩大，听诊可闻及第四心音奔马律，双下肢浮肿，超声心动图报告：左心室腔明显扩大（E错）符合扩张型心肌病（P262）。